普萘洛尔、硝酸甘油、硝苯地平治疗心绞痛的共同作用是
A. 减慢心率
B. 缩小心室容积
C. 扩张冠脉
D. 降低心肌氧耗量
E. 抑制心肌收缩力

正确答案：D。降低心肌氧耗量

解析：硝苯地平属于钙离子拮抗剂，能使心肌收缩力减弱，心率减慢，血管平滑肌松弛，血压下降，心脏负荷减轻，从而降低心肌耗氧量（D对）。硝酸甘油可明显扩张静脉血管，特别是较大的静脉血管，从而减少回心血量，降低心脏前负荷，同时能够使心室容积缩小，心室壁张力降低，射血时间缩短，心肌耗氧量减少；硝酸甘油可选择性扩张心外膜血管和侧支血管，扩张冠脉，增加缺血区血流灌注，但不能够抑制心肌收缩力（E错）以及减慢心率（A错）。普萘洛尔属于β受体阻断药，通过拮抗β受体使心肌收缩力减弱，心率减慢以及血压降低，可明显减少心肌耗氧量，但抑制心肌收缩力作用可增加心室容积（B错），β受体阻断剂不能够扩张冠脉（C错），但是冠脉血管β受体阻断以后，非缺血区与缺血区血管张力差增加促使血液流向缺血区，增加缺血区血流量。